患者，男，50岁。高血压病史10年，今日剧烈头痛，眩晕，恶心，呕吐。查体：无肢体活动障碍，血压200/120mmHg（26.6/16kPa）。为快速降压，应选择下列哪种药物：
A. 硝普钠
B. 心得安
C. 硝苯地平
D. 降压灵
E. 复方降压片

正确答案：A。硝普钠

解析：本例患者为中年男性，有长期高血压病史，此次突发剧烈头痛，眩晕，恶心，呕吐，查体可发现血压200/120mmHg，属于高血压急症。高血压急症是指原发性或继发性高血压患者，在某些诱因作用下，血压突然和明显升高（一般超过180/120mmHg），伴有进行性心、脑、肾等重要靶器官功能不全的表现，其治疗首选硝普钠（A对）。心得安（B错）、硝苯地平（C错）、降压灵（D错）、复方降压片（E错）为高血压的一般治疗药物，对高血压急症的疗效欠佳。